六淫致病初期，症见壮热、脉实有力，其病机为
A. 邪正交争，邪盛正衰
B. 邪正交争，正盛邪退
C. 邪正交争，邪轻正盛
D. 邪正交争，邪正俱盛
E. 正气充盛

正确答案：D。邪正交争，邪正俱盛

解析：本题考查的是邪正盛衰与虚实变化。六淫致病初期，症见壮热、脉实有力，其病机为邪正交争，邪正俱盛（D对）。实，即邪气亢盛，是以邪气盛为矛盾主要方面的病机变化。致病邪气的毒力和机体的抗病能力都比较强盛，或是邪气虽盛而机体的正气未衰，能积极与邪抗争，故正邪相搏，斗争剧烈，反应明显，在临床上出现一系列病变性反应比较剧烈有余的证候，即谓之实证。实证常见于外感六淫致病的初期和中期，或由于痰、食、水、血等滞留于体内而引起的病证。例如，痰涎壅盛、食积不化、水湿泛滥、瘀血内阻等病变，以及壮热、狂躁、声高气租、腹痛拒按、二便不通、脉实有力等，都属于实证。疾病的发展过程中，邪正的消长盛衰变化决定病机、病证的虚实夹杂或转化。一般规律是，正盛邪退（B错）则病势好转或向愈，邪去正虚则病愈而体虚，正虚邪恋则病势缠绵迁延而难愈，邪盛正衰（A错）则病势恶化，甚则死亡。疾病的虚实变化：在疾病的发展变化过程中，正气和邪气这两种力量不是固定不变的，而是正邪双方在其斗争的过程中，在力量对比上发生着消长盛衰的变化。一般来说，正气增长而旺盛（CE错），则必然促使邪气消退，反之，邪气增长而亢盛，则必然会损耗正气。随着体内邪正的消长盛衰，形成了病证的虚实变化。